下列关于苯海索的作用，错误的是
A. 阻断胆碱受体
B. 抗震颤效果好
C. 外周抗胆碱作用弱
D. 在脑内生成DA
E. 用于氯丙嗪引起的帕金森综合征

正确答案：D。在脑内生成DA

解析：苯海索是中枢性M胆碱受体阻断药（A对），该药口服吸收好，易通过血脑屏障，其特点为∶①对帕金森病、脑炎、动脉硬化引起的震颤效果好（B对），但对肌强直、运动徐缓疗效差。②对早期轻症患者疗效较好，而晚期重症疗效差。③其疗效不及左旋多巴，但可作左旋多巴辅助药，或不能耐受左旋多巴者。④对由抗精神病药如氯丙嗪等引起的锥体外系不良反应有效（E对）。⑤外周抗胆碱作用弱（C对），仅有阿托品的1/10～1/3，但闭角型青光眼及前列腺肥大患者禁用本药（D错，为本题正确答案）。